实验流行病学研究设计中关于研究对象的选择，不正确的是
A. 应制订出严格的入选和排除标准
B. 尽可能选择症状和体征不明显的患者做研究对象
C. 研究对象应该能从中受益
D. 新药临床试验时，尽量不选择孕妇作为研究对象
E. 选择依从性好的研究对象

正确答案：B。尽可能选择症状和体征不明显的患者做研究对象

解析：本题考查实验流行病学选择研究对象的原则。根据研究目的的不同，研究对象选择的标准也不同，应制订出严格的入选和排除标准（A对），避免某些外来因素的影响。选择研究对象的主要原则有以下几点：1.选择对干预措施有效的人群；2.选择预期发病率较高的人群；3.选择干预对其无害的人群：如在新药临床试验时，往往将老年人、儿童、孕妇除外（D对），因为这些人对药物易产生不良反应；4.选择能将试验坚持到底的人群；5.选择依从性好的人群（E对）；6.选择研究对象可以从中受益的人群（C对）。尽可能选择症状和体征不明显的患者（B错，为本题正确答案）不属于实验流行病学研究设计中研究对象的选择的范畴。